根据《抗菌药物临床应用管理办法》，特殊使用级抗菌药物可以
A. 在门诊使用
B. 在村卫生室使用
C. 在局部感染时使用
D. 在免疫功能低下时使用
E. 在抢救生命垂危患者时使用

正确答案：E。在抢救生命垂危患者时使用

解析：本题考查的是抗菌药物的应用监测。根据《抗菌药物临床应用管理办法》，特殊使用级抗菌药物可以在抢救生命垂危患者时使用（E对）。抗菌药物的应用监测：医疗机构和医务人员应当严格掌握使用抗菌药物预防感染的指征。预防感染、治疗轻度或者局部感染应当首选非限制使用级抗菌药物（C错）；严重感染、免疫功能低下合并感染或者病原菌只对限制使用级抗菌药物敏感时，方可选用限制使用级抗菌药物（D错）；特殊使用级抗菌药物不得在门诊使用（A错），临床应用特殊使用级抗菌药物应当严格掌握用药指征，经抗菌药物管理工作组指定的专业技术人员会诊同意后，由具有相应处方权医师开具处方（B错）。特殊使用级抗菌药物会诊人员由具有抗菌药物临床应用经验的感染性疾病科、呼吸科、重症医学科、微生物检验科、药学部门等具有高级专业技术职务任职资格的医师、药师或具有高级专业技术职务任职资格的抗菌药物专业临床药师担任。因抢救生命垂危的患者等紧急情况，医师可以越级使用抗菌药物。越级使用抗菌药物应当详细记录用药指征，并应当于24小时内补办越级使用抗菌药物的必要手续。